关于孕妇用药的原则中不正确的是
A. 提倡联合用药
B. 限制用药时间
C. 限制用药剂量
D. 不使用安眠类药物
E. 不使用镇静药物

正确答案：A。提倡联合用药

解析：孕妇用药的原则是：能用一种药物就避免联合用药，能用疗效肯定的药物就避免用尚难确定对胎儿是否有不良影响的新药，应严格限制用药时间和药物剂量。妊娠初期，应防止风疹之类的病毒感染，不使用镇静、安眠类药物，防止可能造成的唇裂或腭裂等畸形的发生。妊娠期嗜好烟酒将增加胎儿畸形危险。同时，应减少咖啡因的摄入量。掌握“妊娠期妇女口腔保健”知识点。